男，11个月。母乳喂养，近3月来面色渐苍白，间断腹泻，原可站立，现坐不稳，手足常颤抖。体检面色苍黄，略浮肿，表情呆滞。血红蛋白80g/L，红细胞2.0×10¹²/L，白细胞6.0×10⁹/L。该患儿最恰当的治疗是
A. 静脉补钙
B. VitC口服
C. 肌注维生素B₁₂
D. 肌注维生素D₃
E. 静滴维生素B₆

正确答案：C。肌注维生素B₁₂

解析：维生素D缺乏性手足搐搦症使用静脉补充钙剂（A错）和肌注维生素D（D错）；缺铁性贫血时与口服铁剂的同时口服维生素C（B错）可增加铁的吸收；营养性巨幼红细胞性贫血就是因为叶酸和维生素B12不足导致，有精神症状时主要以肌注维生素B12（C对）为主，单用叶酸可能会加重病情。